毒物排泄的主要途径是
A. 唾液
B. 母乳
C. 胃肠道
D. 肾脏
E. 汗液

正确答案：D。肾脏